有关口腔保健用品的选择正确的是
A. 冲牙器
B. 电动牙刷
C. 牙间隙刷
D. 改良牙刷
E. 以上说法均正确

正确答案：E。以上说法均正确

解析：口腔保健用品的选择：①改良牙刷；②使用电动牙刷和冲牙器；③使用牙线和牙间隙刷。掌握“残疾人口腔保健”知识点。